关于tRNA的描述哪一项是正确的
A. 5'端是CCA
B. tRNA是由10³苷酸组成
C. tRNA的二级结构是二叶草型
D. tRNA富有稀有碱基和核苷
E. 在其DHU环中有反密码子

正确答案：D。tRNA富有稀有碱基和核苷